分枝杆菌感染引起的疾病是
A. 肺孢子菌感染
B. 病毒性肺炎
C. 大叶性肺炎
D. 肺结核病
E. 小叶性肺炎

正确答案：D。肺结核病

解析：分枝杆菌感染引起的疾病可为肺结核病（D对），主要病变为结核结节、浸润、干酪样变和空洞形成。卡氏肺孢子菌既往把它列为原生动物门，单孢子虫纲，弓形虫目，称为卡氏肺孢子虫或卡氏肺囊虫；近年认为它是一种不典型的真菌，属囊菌纲，故目前认为属于真菌，命名为肺孢子菌。由肺孢子菌感染引起的疾病是肺孢子菌感染（A错）（P248）。大叶性肺炎（C错）（八版病理学P163）是主要由肺炎球菌引起的以肺泡内弥漫性纤维素渗出为主的炎症。小叶性肺炎（E错）（八版病理学P165）是主要由化脓性细菌引起，以肺小叶为病变单位的急性化脓性炎症。